下颌下区舌骨舌肌浅面，自上而下依次排列是
A. 舌神经，下颌下腺导管和舌下神经
B. 下颌下腺导管，舌神经和舌下神经
C. 舌神经，舌下神经和下颌下腺导管
D. 下颌下腺导管，舌下神经和舌神经
E. 舌下神经，舌神经和下颌下腺导管

正确答案：A。舌神经，下颌下腺导管和舌下神经

解析：舌神经、下颌下腺导管和舌下神经均位于下颌下腺深面，在舌骨舌肌的浅面，自上而下依次排列：舌神经、下颌下腺导管、舌下神经。掌握“颈部分区、颈筋膜层次及下颌下三角解剖特点”知识点。